实现“人人享有卫生保健”目标的关键是
A. 推行合作医疗保险
B. 加强医德医风建设
C. 开展初级卫生保键
D. 深化医药卫生体制改革
E. 推进妇幼卫生保健

正确答案：C。开展初级卫生保键

解析：开展初级卫生保键（C对）是实现“人人享有卫生保健”目标的关键。.推行合作医疗保险（A错）、加强医德医风建设（B错）、开展初级卫生保键（C错）、推进妇幼卫生保健（E错）是在开展初级卫生保健工作过程中，所遇到困难的解决措施，而不是实现“人人享有卫生保健”目标的关键。